治疗急性梗阻性化脓性胆管炎最常用的有效手术方式是
A. 急诊胆总管切开引流
B. 胆囊切除术
C. 胆囊造口术
D. 胆管空肠吻合术
E. 胆囊空肠吻合术

正确答案：A。急诊胆总管切开引流

解析：急性梗阻型化脓性胆管炎的发病基础是胆道梗阻及细菌感染。如果在疾病发展过程中，胆道梗阻不能解除，胆管内细菌引起的感染得不到控制，将会危及患者生命。治疗急性梗阻性化脓性胆管炎最常用的有效手术方式是急诊胆总管切开引流（A对），可以解除胆道梗阻。胆囊切除术（B错）和胆囊造口术（C错）为急性胆囊炎所采用的手术治疗方式，其中胆囊造口术为对高危病人和局部粘连不清的患者做的姑息性手术，三个月后还需要行胆囊切除手术根治胆囊炎。胆管空肠吻合术（D错）适用于各种胆管损伤患者，以防止胆汁外漏造成胆源性腹膜炎；也适用于壶腹周围癌的姑息手术，以解决胆道和十二指肠的梗阻和疼痛。胆囊空肠吻合术（E错）适用于胰头或壶腹周围癌早期，不能耐受一次完成胰头切除术，和胆总管先天性狭窄伴有胆囊胀大以及由结石或炎症造成不易解除的胆总管下端梗阻、胆总管狭窄增厚，扩张不显著，但胆囊通畅的患者。